一位足球运动员在比赛运动中不慎扭伤左下肢。检查时，医生右手掌置患者左膝外侧稍偏上向内侧推挤，左手握患者左小腿踝关节上方使小腿外展，患者即感觉左膝内侧疼痛较剧。反之，使患者左小腿被动内收时，则左膝不甚疼痛。受伤的结构可能是
A. 前交叉韧带
B. 后交叉韧带
C. 内侧半月板
D. 腓侧副韧带
E. 胫侧副韧带

正确答案：E。胫侧副韧带

解析：。膝关节韧带有位于膝盖前下方的髌韧带、位于小腿腓侧（外侧）的腓侧副韧带、位于小腿胫侧（内侧）的胫侧副韧带，以及位于膝关节关节囊内的交叉韧带等，题目中，医生将患者小腿外展时，患者疼痛剧烈；使患者小腿内收，患者则无明显感受，即说明患者腿部受伤部位是在外侧，可以得出患者受伤的结构极有可能是胫侧副韧带（E对）。